龈上边缘的缺点是
A. 容易造成菌斑附着
B. 边缘不易密合
C. 易产生继发龋
D. 在前牙区不美观
E. 易形成肩台

正确答案：D。在前牙区不美观

解析：本题考查龈上边缘的缺点。前牙区牙体修复最主要的原则就是美观，但是龈上边缘位于龈上，显露冠边缘，美观性差（D对），这是其主要缺点。也正是因为位于龈上，所以容易制备肩台（E错），这是优点。龈上边缘可以在直视下检查边缘密合度，若不密合，需将修复体重做以保证最终修复体的密合，边缘密合（B错）的好坏是通过明确的肩台预备、精确的取模和制作实现，与龈边缘的位置无关。龈上边缘便于清洁，食物不易滞留，不易产生继发龋（C错）。容易造成菌斑附着（A错）和易产生继发龋是龈下边缘的缺点。